造血原料缺乏，见于
A. 特发性血小板减少性紫癜
B. 再生障碍性贫血
C. 缺铁性贫血
D. 溶血性贫血
E. 慢性粒细胞白血病

正确答案：C。缺铁性贫血

解析：缺铁性贫血是指缺铁所引起的小细胞低色素性贫血及相关的缺铁异常，是血红蛋白合成异常性贫血的一种。其特点是骨髓、肝、脾等器官组织中缺乏可染色性铁，血清铁浓度、转铁蛋白饱和度和血清铁蛋白降低（C对）。特发性血小板减少性紫癜，是一种获得性自身免疫性出血性疾病。约占出血性疾病总数的1/3。该病的发生是由于患者对自身血小板抗原的免疫失耐受，产生体液免疫和细胞免疫介导的血小板过度破坏和血小板生成受抑，出现血小板减少，伴或不伴皮肤黏膜出血的临床表现（A错）。再障是由多种病因引起的骨癫造血功能衰竭，出现以全血细胞减少为主要表现的一组综合征（B错）。溶血性贫血发生的主要机制是红细胞寿命缩短，易于破坏，正常人体内的红细胞寿命平均为120天，主要是因衰老而消失。衰老的红细胞，其结构和功能发生改变，主要被单核-巨噬细胞系统所识别而被清除。另有极少数红细胞可因其他因素导致红细胞的变形性下降或细胞表面性质改变而过早破坏（D错）。慢性粒细胞白血病可由于不明原因的持续性白细胞数增高，根据典型的血象、骨髓象改变，脾肿大，Ph染色体阳性，BCR-ABL融合基因阳性（E错）。